与足太阴相表里的经脉是
A. 手太阳
B. 手少阳
C. 足厥阴
D. 足少阳
E. 足阳明

正确答案：E。足阳明

解析：十二经脉的阳经与阴经之间，通过经脉与脏腑的属络关系，以及经别和别络的相互沟通作用，组成六对“表里相合”关系。如《素问·血气形志》说：“手太阳与少阴为表里（A错），少阳与厥阴为表里（B错），阳明与太阴为表里，是为手之阴阳也。”“足太阳与少阴为表里，少阳与厥阴为表里（CD错），阳明与太阴为表里（E对），是为足阴阳也。”相互表里的两条经脉，在四肢末端交接，分别循行于四肢内、外侧面相对应的位置；分别属络于相为表里的脏与腑；还有经别和别络的表里沟通，形成了脏腑经脉表里相合关系。